第二乳磨牙与第一恒磨牙的区别要点中哪一点是错误的
A. 第二乳磨牙的牙冠较小、色白
B. 第二乳磨牙的牙冠颈部明显缩小，颈嵴较突
C. 第二乳磨牙的牙冠（牙合）面尖窝清晰
D. 第二乳磨牙的近中颊尖、远中颊尖、远中尖大小约相等
E. 第二乳磨牙的牙根干短，牙根向外张开

正确答案：C。第二乳磨牙的牙冠（牙合）面尖窝清晰

解析：本题考查第二乳磨牙与第一恒磨牙的鉴别。第二乳磨牙的牙冠牙合面尖窝清晰（C错，为本题正确答案）不属于第二乳磨牙与第一恒磨牙的区别。第二乳磨牙与同颌第一恒磨牙形态近似，但牙冠及牙合面较小，牙合面尖窝不明显。而第一恒磨牙牙合面结构复杂，尖窝起伏，沟嵴交错，更加清晰。第二乳磨牙的牙冠较第一恒磨牙小，呈乳白色（A对）。第二乳磨牙邻面观可见牙冠近颈缘明显缩小，颈嵴突出（B对），牙冠由颈部向牙合方聚拢,近颈部大而牙合面小。下颌第二乳磨牙的近中颊尖、远中颊尖及远中尖的大小约相等（D对），而下颌第一恒磨牙近中颊尖＞远中颊尖＞远中尖。上颌第二乳磨牙为三根，下颌第二乳磨牙为二根，根干短，根分叉大（E对）。